属于碳青霉烯类的抗菌药物有
A. 亚胺培南
B. 氨曲南
C. 美罗培南
D. 厄他培南
E. 比阿培南

正确答案：A、C、D、E。亚胺培南；美罗培南；厄他培南；比阿培南

解析：本题考查抗菌药物的分类。碳青霉烯类抗菌药物有亚胺培南（A对）、美罗培南（C对）、厄他培南（D对）、比阿培南（E对）。氨曲南（B错）为单环β-内酰胺类抗菌药物。